治疗痞满饮食内停证，应首选
A. 枳实导滞丸
B. 保和丸
C. 越鞠丸合枳术丸
D. 二陈平胃散
E. 香砂六君子汤

正确答案：B。保和丸

解析：枳实导滞丸为痞满饮食停滞证伴食积化热，大便秘结者的选方，功能推荡积滞，清利湿热。（A错）。痞满饮食内停证为饮食停滞，胃腑失和，气机壅塞所致，治疗要消食行气，使胃和痞消，方选保和丸（B对）。越鞠丸合枳术丸为痞满肝胃不和证的选方，两方合用功能疏肝解郁，和胃消痞（C错）。二陈平胃散为痞满痰湿中阻证的选方，功能燥湿健脾，化痰利气（D错）。香砂六君子汤为痞满脾胃虚弱证伴舌苔厚腻，湿浊内蕴者的选方，功能健脾祛湿，理气除胀（E错）。